再次应答最主要的特点是
A. 产生Ab潜伏期长
B. 抗体的潜伏期短
C. IgM产生量大
D. IgG与IgM的产生量相似
E. IgG的亲和力没变化

正确答案：B。抗体的潜伏期短

解析：再次体液免疫应答的特点是：产生抗体的潜伏期短，产生的抗体的滴度高、维持的时间长且多为高亲和性IgG等其他类抗体。掌握“B细胞、T细胞介导的免疫应答”知识点。